翼下颌间隙感染的来源是
A. 上颌磨牙的根尖周脓肿
B. 化脓性扁桃体炎
C. 下牙槽神经阻滞麻醉消毒不严
D. 化脓性中耳炎
E. 上颌尖牙根尖化脓性炎症

正确答案：C。下牙槽神经阻滞麻醉消毒不严

解析：翼下颌间隙感染来源常见为下颌智牙冠周炎及下颌磨牙尖周炎症扩散所致；下牙槽神经阻滞麻醉时消毒不严也可引起翼下颌间隙感染；此外，相邻间隙，如颞下间隙、咽旁间隙炎症也可波及。掌握“翼下颌间隙、颞下间隙感染”知识点。